某患者41变色牙，要求烤瓷冠修复，对41牙体预备的要求正确的是
A. 肩台宽度0.5mm
B. 可设计为金属颈圈
C. 轴面聚合度不超过10°
D. 设计为龈上肩台
E. 牙体颈缘预备成135°凹面肩台

正确答案：E。牙体颈缘预备成135°凹面肩台

解析：本题考查烤瓷熔附金属冠的牙体预备。某患者41变色牙，要求烤瓷冠修复，对41牙体预备的要求正确的是牙体颈缘预备成135°凹面肩台（E对）。烤瓷熔附金属冠的牙体预备要求：唇颊侧肩台宽度一般为1.0mm（A错），若预备不足，要么颈部瓷层太薄，出现金属色或透明度降低，冠边缘的强度下降；要么为了保证强度而增加冠边缘突度，致使颈部外形与牙颈部不一致，冠颈部形成肿胀外观（B错）。若预备过多，可能会引起牙髓损害，因为颈部髓腔壁厚度一般为1.7-3.0mm，舌侧金属边缘处肩台宽度0.5mm。轴面聚合度为2～5°（C错），聚合度可影响修复体的就位，因此不可过大或过小，2～5°为宜。龈上肩台（D错）一般不宜使用于前牙。